患者女，35岁。发热、腰痛、尿频、尿急1个月，近4天全身关节酸痛、尿频、尿急加重。体检：体温39.5℃，白细胞13×109/L，中性粒细胞86%，尿培养大肠杆菌阳性，诊断为大肠杆菌性尿路感染，应首选
A. 青霉素
B. 庆大霉素
C. 灰黄霉素
D. 头孢曲松
E. 林可霉素

正确答案：D。头孢曲松

解析：对急性肾盂肾炎患者应选用血、尿药物浓度均高的药物。常用药物有喹诺酮类、头孢菌素类、氨基糖苷类及半合成青霉素类，重症患者可两类药物如半合成青霉素类与头孢菌素类或氨基糖苷类合用。掌握“急性肾孟肾炎、尿路结石及慢性肾衰竭”知识点。